杀菌作用较强，口服易吸收的β-内酰胺类抗生素
A. 磺胺嘧啶
B. 头孢氨苄
C. 甲氧苄啶
D. 青霉素钠
E. 氯霉素

正确答案：B。头孢氨苄

解析：本题考查头孢菌素类抗菌药。头孢氨苄（B对）为β-内酰胺类抗生素，可口服，杀菌效应强。磺胺嘧啶（A错）为口服磺胺药,具有广谱的抑菌活性。甲氧苄啶（C错）为抗菌增效剂，有抑制二氢叶酸还原酶的作用。青霉素钠（D错）是青霉素类药物，阻碍细菌细胞壁的合成,从而有杀菌的作用。氯霉素（E错）主要通过抑制细菌蛋白质的合成,起到抑制细菌的作用。